患者，女，26岁，已婚。月经35天一行，量少、色淡、质稀，每于行经出现大便泄泻，腰酸畏寒，四肢不温，带下清稀如水，舌淡苔白，脉沉迟。其证候是
A. 脾虚
B. 肾虚
C. 湿热
D. 寒湿
E. 肝木乘脾

正确答案：B。肾虚

解析：该患者肾阳虚衰，命火不足，不能上温脾阳，经行则肾虚益甚，水湿下注，是以经行泄泻。肾阳虚衰不能温养脏腑，影响血之生化，故经色淡而质清稀；阳虚经脉失去温煦，则畏寒肢冷，带下清稀如水。舌淡苔白，脉沉迟为肾阳虚衰之候（B对）。脾虚证主要有脘腹胀满，神疲肢软，或面浮肢肿等证候表现（A错）。湿热证主要有脘腹痞满，纳呆食少，恶心呕吐，身热不扬，肢体困重，便溏不爽等证候表现（C错）。寒湿证主要有腹痛便溏，头身困重，肢体肿胀，面色晦暗不泽，
或妇女白带量多等证候表现（D错）。肝木乘脾主要有经性腹痛即泻，泻后痛止，兼胸胁痞满闷，嗳气不舒等证候表现（E错）。